阿司匹林具有抗血小板聚集的作用，是因为阿司匹林可抑制血小板的
A. 磷脂酶A₂
B. 过氧化酶
C. 环氧化酶
D. 血栓素合成酶
E. 前列腺素合成酶

正确答案：C。环氧化酶